男性，56岁。反复上腹部痛，多在餐后很快发作，不易用抑酸剂控制，每次发作时频繁呕吐。最可能的诊断是
A. 胃角溃疡
B. 十二指肠球部溃疡
C. 十二指肠球后溃疡
D. 幽门管溃疡
E. 胃体溃疡

正确答案：D。幽门管溃疡

解析：老年男性患者，反复上腹部痛，餐后很快发作，每次发作时频繁呕吐，不易用抑酸剂控制（溃疡发在幽门管，进食后食物不能快速通过幽门进入肠道，表现为餐后很快发生疼痛，早期出现呕吐，对药物治疗反应差），考虑诊断为幽门管溃疡（D对）。胃溃疡（AE错）多于餐后1小时疼痛；十二指肠球部溃疡（B错）餐前痛、夜间痛多见，两者抑酸剂均可控制，发作时均无频繁呕吐。十二指肠球后溃疡（C错）疼痛规律和十二指肠球部溃疡类似，但可向右上腹及背部放射，易出血，严重的炎症反应可导致胆总管引流障碍，出现梗阻性黄疸或引发急性胰腺炎。